随时消毒是
A. 一级预防
B. 二级预防
C. 三级预防
D. 传染病的预防性措施
E. 传染病的防疫性措施

正确答案：E。传染病的防疫性措施

解析：本题考查传染病的防疫性措施。随时消毒是指当传染源还在疫源地时，对其排泄物、分泌物、被污染的物品及场所进行的及时消毒。它属于传染病的防疫性措施（E对ABCD错）。